盛暑行军时大量出汗可发生
A. 等渗性脱水
B. 高渗性脱水
C. 低渗性脱水
D. 水中毒
E. 水肿

正确答案：B。高渗性脱水

解析：汗腺分泌出来的汗液渗透压是与血浆相等，但在流经汗腺管腔时，在醛固酮的作用下，汗液中的钠离子和氯离子被重吸收，最后排出的汗液是低渗的。盛暑行军时大量出汗由于机体排出大量低渗性汗液，可出现高渗性脱水（B对），若只补充水分，可转变为低渗性脱水（C错）。等渗性脱水（A错）为水钠成比例丢失，而汗液为低渗液。大量出汗体液大量丧失，不会出现水中毒（D错）和水肿（E错）。